癌症患者申办“麻醉药品专用卡”应提供
A. 由三级以上（含三级）医疗机构出具的诊断证明书
B. 由患者所在单位开具的介绍信或由街道居委会开具的证明材料
C. 由主治医师和主管药师共同开具的麻醉药品处方
D. 由二级以上（含二级）医疗机构医师开具的麻醉药品处方
E. 由二级以上（含二级）医疗机构开具的诊断证明书、患者户口簿、身份证

正确答案：E。由二级以上（含二级）医疗机构开具的诊断证明书、患者户口簿、身份证